属于人群分布的是
A. 石棉工人中间皮瘤、肺癌及胃肠癌的发生率高于其他职业人群
B. 水痘、流行性脑脊髓膜炎和流行性感冒等常在大城市发生流行
C. 因诊断水平的提高使患病率升高
D. 流行性乙型脑炎和脊髓灰质炎多为隐性感染
E. 2015年上海市甲型H1N1流感流行在冬春季节

正确答案：A。石棉工人中间皮瘤、肺癌及胃肠癌的发生率高于其他职业人群

解析：本题考查疾病的人群分布。人群的一些固有特征或社会特征可构成疾病或健康状态的人群特征，这些特征包括：年龄、性别、职业、种族和民族、婚姻与家庭、行为生活方式、宗教信仰、人口流动等。如石棉工人（A对）符合人群中的职业特征。